维生素A的特点不包括
A. 对高温和碱稳定
B. 脂肪酸败可引起严重破坏
C. 摄入过多可引起中毒
D. 是黄素酶的辅酶成分
E. 具有抗氧化作用

正确答案：D。是黄素酶的辅酶成分